乳化剂属于热力学不稳定的非均相分散系统，制成后，放置过程中容易出现分层、絮凝等不稳定现象，若出现的絮凝现象经振摇后能恢复原状其原因是
A. 分散相乳滴ξ（Zeta）电位降低
B. 分散相与连续相存在密度差
C. 乳化剂类型改变
D. 乳化剂失去乳化作用
E. 微生物的作用

正确答案：A。分散相乳滴ξ（Zeta）电位降低

解析：本题考查乳剂。絮凝指乳剂中分散相的乳滴由于某些因素的作用使其荷电减少，ζ-­电位降低（A对），出现可逆性的聚集现象。分散相与连续相存在密度差（B错）是引起乳剂分层的原因。乳化剂类型改变（C错）是引起乳剂转相的原因。乳化剂失去乳化作用（D错）是引起乳剂破裂的原因。微生物的作用（E错）是引起乳剂酸败的原因。